血站对献血者每次采集血液量最多为
A. 200毫升
B. 250毫升
C. 300毫升
D. 400毫升
E. 500毫升

正确答案：D。400毫升

解析：《献血法》规定，血站对献血者每次采集血液量一般为200毫升（A错），最高不得超过400毫升（D对）；献血间隔不得少于6个月。